对同一人群的两个随机样本进行调查，其结果的一致程度被称为
A. 真实性
B. 可靠性
C. 灵敏度
D. 特异度
E. 约登指数

正确答案：B。可靠性